低钙血症患者的Chvostek征指的是
A. 手指针尖样刺痛
B. 腱反射亢进
C. 口角紧张
D. 面神经叩击阳性
E. 踝阵挛

正确答案：D。面神经叩击阳性

解析：低钙血症患者的Chvostek征，即为面神经叩击征（D对），出现口周麻木和刺痛、面部肌肉痉挛等症状，为甲状旁腺功能减退症的临床表现之一；手指针尖样刺痛常见于手指尖末梢神经炎（A错）；腱反射亢进常见于椎体束损伤，表现为上下肢深反射亢进（B错）；口角紧张常见于口角炎（C错）；踝阵挛是神经系统疾病的一种病理反射，阳性时表现为踝关节节律性往复伸屈动作（E错）。